三七中的止血活性成分是
A. 槲皮素
B. 三七多糖
C. 三七皂苷Rg₁
D. 人参皂苷
E. 田七氨酸

正确答案：E。田七氨酸

解析：本题考查的是三七的药理作用。三七中的止血活性成分是田七氨酸（E对）。三七的药理作用，三七具有较强的止血作用。三七粉、三七注射液、三七氨酸可缩短出血时间、凝血时间和凝血酶原时间，增加血小板数量和功能，增加凝血酶含量，促进纤维蛋白形成，收缩局部血管。扩张血管，改善微循环。三七皂苷可舒张血管，其中对冠状动脉的血管舒张作用最强，并具有一定的血管内皮依赖性。三七皂苷能改善肠系膜、冠状动脉、肝脏微循环。三七皂苷Rg₁（C错）可改善耳廓微循环、脑微循环。槐花炒黄加热可破坏鼠李糖转化酶，有利于芦丁的保存，并可使药材组织疏松，便于成分的煎出。槐花炒炭后大部分芦丁、氨基酸、糖和叶绿素受热破坏，具有止血作用的槲皮素（A错）含量显著增加，但拮抗槲皮素止血作用的异鼠李素含量降低。人参的药理作用，增强免疫功能。人参能提高免疫功能低下的动物巨噬细胞吞噬活性及NK细胞活性，提高抗原刺激小鼠的抗体水平。人参皂苷（D错）、人参多糖是人参提高免疫功能的有效成分。